下列哪项不属于不孕症的常见证型
A. 肝郁
B. 肾虚
C. 血瘀
D. 脾虚
E. 湿热

正确答案：D。脾虚

解析：肝气郁结，导致冲任不能相资，不能摄精成孕（A对）。肾气虚（B对）则冲任虚衰，，不能摄精成孕；肾阳虚，命门火衰，生化失期，有碍子宫发育或不能触发氤氲乐育之气，故发为不孕症； 肾阴亏虚，天癸乏源，冲任血海空虚； 或阴虚生内热，热扰冲任血海，均不能摄精成孕，发为不孕症（B对）。瘀滞冲任，胞宫、胞脉阻滞不通导致不孕（C对）。湿热内蕴，蕴而生热，流注下焦，阻滞冲任胞脉，壅塞胞宫，不能摄精成孕（E对）。脾虚为后天失养，不孕症之虚证通常为先天性肾气亏虚所致，故脾虚非不孕症常见证型（D错，为本题正确答案）。